肝硬化大量腹水不会出现的腹部体征是
A. 腹部膨隆
B. 液波震颤阳性
C. 振水音阳性
D. 移动性浊音阳性
E. 蛙状腹

正确答案：C。振水音阳性

解析：肝硬化大量腹水可以出现腹部膨隆（A对）、液波震颤阳性（B对）、移动性浊音阳性（D对）、蛙状腹（E对），其中腹水在1000ml以上时出现移动性浊音阳性，腹水在3000～4000ml以上时出现液波震颤阳性。振水音是指用撞击触诊法振动胃部，听到气、液撞击的声音。振水音阳性（C错，为本题正确答案）既可以出现在正常人餐后或饮进多量液体时，也可以出现在幽门梗阻或胃扩张的患者。